早萌乳牙的牙位多见于
A. 上颌乳中切牙
B. 下颌乳中切牙
C. 上颌乳侧切牙
D. 下颌乳尖牙
E. 第一乳磨牙

正确答案：B。下颌乳中切牙

解析：本题考查乳牙早萌。早萌乳牙的牙位多见于下颌乳中切牙（B对）。1.乳牙早萌较少见，有以下两种早萌现象，一种称诞生牙，另一种称新生牙。诞生牙是指婴儿出生时口腔内已萌出的牙齿；新生牙是指出生后30天内萌出的牙齿。诞生牙和新生牙多见于下颌中切牙。2.恒牙早萌多见于前磨牙，下颌多于上颌。